某男性工人，接尘工龄21年，诊断一期石棉肺半年，主诉轻度运动后即感呼吸困难，体温正常，无明显咳痰。如进行肺通气功能检查，其特征性改变是
A. 肺活量和用力肺活量均正常
B. 用力肺活量下降，第一秒用力呼气容积/用力肺活量基本正常
C. 肺活量降低，用力肺活量基本正常
D. 肺活量异常，用力肺活量正常
E. 肺活量正常，用力肺活量异常

正确答案：B。用力肺活量下降，第一秒用力呼气容积/用力肺活量基本正常

解析：本题考查石棉肺肺功能变化。石棉肺病人由于肺间质弥漫性纤维化，严重损害肺功能。早期肺功能损害是由于弥漫性纤维化后，肺脏硬化，从而导致肺顺应性降低，表现为肺活量渐进性下降，这是石棉肺肺功能损害的特征。。随着病情加重，多数石棉肺病人肺功能改变主要表现为肺活量、用力肺活量、肺总量下降，而第一秒用力呼气容积／用力肺活量变化不大（B对ACDE错）。